既能治肺痨咳嗽，又能治蛲虫病及头虱、体虱的药物是
A. 瓜蒌
B. 白芥子
C. 百部
D. 葶苈子
E. 桔梗

正确答案：C。百部

解析：本题考查的是百部的主治病证。既能治肺痨咳嗽，又能治蛲虫病及头虱、体虱的药物是百部（C对）。百部：【主治病证】（1）新久咳嗽，百日咳，肺痨咳嗽。（2）蛲虫病，头虱，体虱。瓜蒌（A错）：【主治病证】（1）肺热咳嗽、痰稠不易咳出。（2）胸痹，结胸。（3）乳痈肿痛，肺痈，肠痈。（4）肠燥便秘。白芥子（B错）即芥子。芥子：【主治病证】（1）寒痰咳喘，悬饮胁痛。（2）痰阻经络之肢体关节疼痛，阴疽流注。葶苈子（D错）：【主治病证】（1）痰壅肺实之咳喘。（2）浮肿尿少，小便不利。桔梗（E错）：【主治病证】（1）咳嗽痰多、咯痰不爽，咽痛音哑。（2）肺痈胸痛、咳吐脓血、痰黄腥臭。